治疗乳癌情志郁结证，应首选
A. 逍遥散合开郁散
B. 柴胡疏肝散合开郁散
C. 逍遥散合香贝养荣汤
D. 神效瓜蒌散合开郁散
E. 瓜蒌牛蒡汤合开郁散

正确答案：D。神效瓜蒌散合开郁散

解析：神效瓜蒌散合开郁散功能疏肝解郁，化痰散结，活血化瘀，理气止痛，适用于因情志郁结而产生的乳癌（D对）。逍遥散的功效是疏肝解郁，健脾和营（A错）。柴胡疏肝散的功效是疏肝行气，活血止痛（B错）。香贝养荣汤治上石疽属气血两虚者（D错）。瓜蒌牛蒡汤的功效是清阳明胃热，疏厥阴之气（E错）。